适用于砭镰疗法治疗的疾病是
A. 抱头火丹
B. 有头疽
C. 红丝疔
D. 赤游丹
E. 臀痈

正确答案：C。红丝疔

解析：抱头火丹在头面部，而头面颈部不适宜用砭镰法（A错）。有头疽多见于中老年人及消渴病患者，均体质虚而气血虚弱，消渴患者阴虚为本，而砭镰法不适用于阴证、虚证（B错）。红丝疔发于四肢，为砭镰法的适应证（C对）。赤游丹新生儿多见，发于臀部，与臀痈均为皮肉肥厚处，砭镰法的手法为轻、准、浅、快，不适合皮肉肥厚处（DE错）。